为S-（-）-光学异构体，体内代谢慢，维持时间长的抗溃疡药物是
A. 奥美拉唑
B. 埃索美拉唑
C. 兰索拉唑
D. 泮托拉唑
E. 雷贝拉唑

正确答案：B。埃索美拉唑

解析：本题考查埃索美拉唑。埃索美拉唑（B对）是奥美拉唑（A错）的S-（-）-光学异构体，主要被CYP3A4作用，在体内的代谢清除率低，经体内循环更易重复循环，维持时间更长，有更优良的药理性质。兰索拉唑（C错）也存在S、R两种异构体，本身并不是S型异构体。雷贝拉唑（E错）是在兰索拉唑的基础上发展起来的，在兰索拉唑吡啶环上的4位延长了侧链；泮托拉唑（D错）也具有两个手性异构体，在体内可发生右旋体向左旋体的转化。